小儿久咳、汗出、体虚者忌用的药是
A. 儿童咳液
B. 儿童清肺口服液
C. 解肌宁嗽口服液
D. 小儿止咳糖浆
E. 小儿咳喘灵颗粒

正确答案：B。儿童清肺口服液